治疗特发性高尿钙症伴尿结石可选用
A. 呋塞米
B. 氢氯噻嗪
C. 螺内酯
D. 甘露醇
E. 氨苯蝶啶

正确答案：B。氢氯噻嗪

解析：本题考查氢氯噻嗪的适应症。治疗特发性高尿钙症伴尿结石可选用氢氯噻嗪（B对）。氢氯噻嗪可用于治疗特发性高尿钙症伴尿结石、水肿型疾病、高血压、中枢性或肾性尿崩症。呋塞米（A错）用于治疗水肿性疾病。螺内酯（C错）用于治疗水肿性疾病、高血压。甘露醇（D错）用于降颅压，以防止脑疝。氨苯蝶啶（E错）用于治疗治疗水肿性疾病、水钠潴留。